某慢性肺心病合并腹泻患者血气分析结果为：pH7.12,PaCO₂11.3kPa(84.6mmHg),HCO₃⁻26.6mmol/L,Na⁺137mmol/L,CL⁻85mmol/L其酸碱紊乱类型为
A. 呼吸性酸中毒合并AG增高性代谢性酸中毒
B. 呼吸性酸中毒合并代谢性碱中毒
C. 代谢性液中毒
D. 呼吸性酸中毒
E. 呼吸性酸中毒合并AG正常性代谢性酸中毒

正确答案：A。呼吸性酸中毒合并AG增高性代谢性酸中毒

解析：pH7.12<7.35可判定为酸中毒,引起酸中毒的原因可能有PaCO₂增高或HCO3-下降，由于患者PaCO₂（正常范围为33~46 mmHg）增高，故可判断为呼吸性酸中毒。AG= Na+- (HC03-+Cl-）=25.4 mmoI/L>16 mmoI/L，提示患者存在AG增高性代谢性酸中毒，故其其酸碱紊乱类型为呼吸性酸中毒合并AG增高性代谢性酸中毒（A对）。